弗兰明汉姆城市最近的健康检查中患有心脏疾病的女性的数量/同期弗兰明汉姆城市居住的女性的数量
A. 发病率
B. 患病率
C. 死亡率
D. 病死率
E. 罹患率

正确答案：B。患病率

解析：本题考查患病率。患病率（B对ACDE错）是指某特定时间内总人口中某病新旧病例所占的比例。患病率可按观察时间的不同分为期间患病率和时点患病率两种。